儿茶酚胺对心肌细胞的作用主要是
A. 增加K⁺通道的通透性
B. 增加Na⁺通道的通透性
C. 增加Ca²⁺和K⁺的通透性
D. 降低K⁺通道的通透性
E. 增加Ca²⁺通道的通透性

正确答案：E。增加Ca²⁺通道的通透性